以下是土壤中有机污染物在需氧条件下无机化产生的最终产物，除了
A. 氯化物
B. 硝酸盐
C. 二氧化碳
D. 硫酸盐
E. 甲烷

正确答案：E。甲烷

解析：本题考查土壤中有机污染物在需氧条件下无机化产生的最终产物。土壤中有机污染物在需氧条件下无机化产生的最终产物有氯化物（A对）、硝酸盐（B对）、二氧化碳（C对）、硫酸盐（D对）、磷酸盐等。甲烷（E错，为本题正确答案）是土壤中有机污染物在厌氧条件下发生分解的最终产物。